进行居民吸烟率的社会调查时，先抽出若干街道，再从中各抽得两个居委会进行各户普查，这种调查方法是
A. 单纯随机抽样
B. 系统抽样
C. 分层抽样
D. 整群抽样
E. 多阶段抽样

正确答案：E。多阶段抽样

解析：本题考查多阶段抽样的应用。多阶段抽样（E对ABCD错）是指将抽样过程分阶段进行，每个阶段使用的抽样方法往往不同，即将以上抽样方法结合使用。其实施过程为：先从总体中抽取范围较大的单元，称为一级抽样单位，再从每个抽得的一级单元中抽取范围较小的二级单元……以此类推，最后抽取其中范围更小的单元（如村、居委会）作为调查单位。题中的抽样方法，满足多阶段抽样的特点。